女，33岁。右下腹痛、便秘1年。X线钡剂灌肠检查发现回肠末端及升结肠起始部纵行溃疡及鹅卵石征，病变呈节段性。PPD试验阴性。最可能的诊断是
A. 肠结核
B. 阿米巴病
C. 结肠癌
D. 溃疡性结肠炎
E. 克罗恩病

正确答案：E。克罗恩病

解析：中年女性患者，右下腹痛（克罗恩病腹痛多位于右下腹或脐周）、便秘1年。X线钡剂灌肠：回肠末段及升结肠起始部（克罗恩病的好发部位）纵行溃疡及鹅卵石征，病变呈节段性（克罗恩病的典型结肠镜表现）。PPD试验阴性（鉴别肠结核）。综合该患者的病史、结肠镜检查，考虑诊断为克罗恩病（E对）。肠结核（P368）（A错）PPD试验阳性，多有低热、盗汗、乏力等结核中毒症状，结肠镜下可见回盲部带状溃疡、炎性息肉、肠腔环形狭窄。阿米巴病（八版传染病学P274）（B错）有黏液脓血便，粪质较多并有腥臭，结肠镜检查常见大小不等的散在溃疡，中心有渗出，边缘整齐并有周边红晕。结肠癌（P382）（C错）发病年龄多在40～60岁，好发于直肠，多表现为鲜血便，直肠镜检可见火山状溃疡。溃疡性结肠炎（P374）（D错）临床以反复发作的腹泻、黏液脓血便、左下腹或下腹阵痛为特征，结肠镜下可见黏膜充血水肿，弥漫性糜烂和多发性浅溃疡形成。